有关胫前动脉的描述，错误的是
A. 于腘肌下缘发自腘动脉
B. 穿小腿骨间膜则至小腿骨间膜前面
C. 沿小腿前群肌之间下降
D. 于踝关节前方移行为足背动脉
E. 与足底外侧动脉吻合形成足底弓

正确答案：E。与足底外侧动脉吻合形成足底弓

解析：胫前动脉于腘肌下缘发自腘动脉（A对）。穿小腿骨间膜则至小腿骨间膜前面（B对）。在小腿前群肌之间下行（C对）。至踝关节的前方移行为足背动脉（D对）。足背动脉的足底深支（E错，为本题正确答案）与足底外侧动脉吻合形成足底弓。